引起生殖器水泡样病变的病原体是
A. 苍白密螺旋体
B. 淋病奈瑟菌
C. 人乳头瘤病毒
D. 沙眼衣原体
E. 单纯疱疹病毒

正确答案：E。单纯疱疹病毒

解析：单纯疱疹由单纯疱疹病毒引起的，临床以蔟集性水泡为特征，有自限性，但易复发，是世界范围内流行最广泛的感染之一。HSV-1型初发感染多发生在5岁以下幼儿，通过接吻或其他生活密切接触感染，主要引起生殖器以外的皮肤黏膜及脑部感染；HSV-2型初发感染主要发生在青年人或成人，通过密切性接触传播，引起生殖器部位感染。因此，引起生殖器水泡样病变的病原体是单纯疱疹病毒（E对）。梅毒螺旋体通常不易着色，故又称苍白螺旋体（A错）。梅毒是由梅毒螺旋体引起的一种慢性传染病，主要通过性接触和血液传播（P221）。淋病由淋病奈瑟菌（B错）感染引起，主要表现为泌尿生殖系统的化脓性感染，也可导致眼、咽、直肠感染和播散性淋球菌感染（P227）。HPV主要感染上皮组织，HPV-16、18、45、56型最常见的致宫颈癌高危型。因此，人乳头瘤病毒（C错）是宫颈癌发病有关的病原体。性病性淋巴肉芽肿，又称第四性病，由沙眼衣原体（D错）引起（P235）。